对存在职业病危害的用人单位，在正常生产运行阶段，存在和（或）产生的主要职业病危害因素及其危害程度、对劳动者健康的影响、职业病危害防护措施及效果等进行综合的阶段性分析和评价，属于
A. 职业病危害预评价
B. 职业病危害控制效果评价
C. 职业病危害现状评价
D. 职业卫生调査
E. 生物监测

正确答案：C。职业病危害现状评价